女，28岁。已婚未孕，进行性痛经。妇科检查：宫颈糜烂Ⅰ度，子宫正常大小，后倾，活动欠佳，附件增厚压痛，直肠子宫凹陷触及2个结节。最可能的诊断是
A. 盆腔结核
B. 宫颈癌
C. 慢性盆腔炎
D. 子宫内膜异位症
E. 子宫肌瘤

正确答案：D。子宫内膜异位症

解析：子宫内膜异位症的典型临床表现为继发性痛经、进行性加重，盆腔检查时后倾固定，直肠子宫凹陷扪及触痛结节，附件区触及囊实性包块（附件増厚压痛），根据患者的临床表现和实验室检查，最可能的诊断是子宫内膜异位症（D对）。盆腔结核（生殖器官结核）（P265-P266）的常见临床表现为不孕、月经失调、下腹坠痛及低热、乏力、盗汗等全身症状，由于患者无以上症状，因此不考虑盆腔结核（A错）。宫颈癌（P306）的常见临床表现为接触性的阴道流血和阴道排液，由于患者无以上症状，因此不应首先考虑宫颈癌（B错）。慢性盆腔炎常为急性盆腔炎未彻底治疗而反复发作者，常见临床表现为腰腹疼痛、月经异常、不孕，由于患者患者无以上症状，因此不考虑慢性盆腔炎（C错）。子宫肌瘤（P311）最常见的症状是周期基本正常，经量增多及经期延长，由于患者无以上症状，因此不考虑子宫肌瘤（E错）。